上颌覆盖种植义齿修复最少需要植入的种植体有
A. 2颗
B. 3颗
C. 4颗
D. 5颗
E. 6颗

正确答案：C。4颗

解析：本题考查种植修复。上颌覆盖种植义齿修复最少需要植入的种植体有4颗（C对）。全颌（半颌)覆盖式种植义齿用于全颌（半颌）失牙区骨吸收严重，种植2～4颗种植体的无牙颌。全颌覆盖式种植义齿在种植体基台上可设计按扣、杆卡、球帽、磁附着体、套筒冠等连接形式。